具有光化学毒性的中药化学成分类型是
A. 多糖
B. 无机酸
C. 鞣质
D. 呋喃香豆素
E. 五环三萜

正确答案：D。呋喃香豆素

解析：本题考查的是香豆素类化合物的理化性质。具有光化学毒性的中药化学成分类型是呋喃香豆素（D对）。呋喃香豆素的光化学毒性：许多香豆素具有光敏作用。呋喃香豆素外涂或内服后经日光照射可引起皮肤色素沉着。在所有的呋喃香豆素类化合物中，补骨脂素和异补骨脂素是中药补骨脂主要的有效成分，也是研究最多、最深入的呋喃香豆素，此类化合物主要是通过光敏反应发挥生物效应，可用于治疗白斑病。多糖（A错）存在于许多中药中，一些中药中的多糖具有很强的生物活性。如香菇多糖、灵芝多糖、猪苓多糖等均具有抗肿瘤作用；昆布中的昆布素有治疗动脉粥样硬化作用；黄芪多糖和人参多糖具有免疫调节作用；银耳多糖能有效地保护肝细胞等。鞣质（C错）可与蛋白质、三氯化铁、重金属等发生反应。五环三萜（E错）类化学成分具有发泡性，个别还具有溶血性。无机酸（B错）的性质，2022年考试指南未明确说明。